患者，男，18岁。腹痛2日，下痢赤白，里急后重，肛门灼热，口渴，舌苔黄腻，脉滑数。治疗应首选
A. 合谷、中脘、气海
B. 合谷、天枢、上巨虚
C. 合谷、下脘、关元
D. 曲池、梁门、足三里
E. 曲池、上巨虚、内关

正确答案：B。合谷、天枢、上巨虚

解析：该患者腹痛、下痢赤白、里急后重，当为痢疾，其肛门灼热，口渴，舌苔黄腻，脉滑数，辨证为湿热痢，方义：天枢为大肠募穴，合谷为大肠原穴，可通调肠腑的气血，理气化滞，行血则脓血自愈，调气则后重自除。上巨虚为大肠下合穴，“合治内腑”，可清化肠道湿热（B对）。中脘用于寒湿痢，气海以补气为主（A错）。下脘、关元偏重于补虚，无清利湿热之功（C错）。曲池可用于湿热痢，但搭配中少了理气化滞的主穴（D错）。内关无通调肠腑的气血之功（E错）。